某患者诊断为急性根尖周炎，要行根管治疗，开始1周症状明显缓解，后因工作忙未及时就诊，3个月期间换了3次Fc，封药后症状加重。分析其原因，考虑主要是
A. 感染没有控制
B. 药效丧失
C. 药物半抗原作用
D. 机体抵抗力降低
E. 化学性根尖周炎

正确答案：C。药物半抗原作用

解析：本题考查根管充填。甲醛甲酚（Fc）杀菌能力最强，但由于这类药物挥发性强，有效作用时间短，毒副作用较大，可作为半抗原（C对），与牙髓根尖周围组织的宿主蛋白结合，形成免疫原引起抗原免疫反应，国际上不推荐使用。故C项为其原因，而E项为其导致的结果。